由肠系膜上动脉分支供应的器官是
A. 心
B. 支气管
C. 卵巢
D. 子宫
E. 空肠

正确答案：E。空肠

解析：空肠（E对）、回肠、胰、十二指肠、回肠末端、盲肠、阑尾、升结肠和横结肠均为由肠系膜上动脉分支供应的器官。